六腑中,“主液”的是
A. 胆
B. 胃
C. 小肠
D. 大肠
E. 膀胱

正确答案：C。小肠

解析：小肠在吸收水谷精微的同时，还吸收了大量的水液，与水谷精微融合为液态物质，由脾气转输到全身脏腑形体官窍。其中较清晰者上输于肺，经肺气的宣发肃降作用，布散于全身的皮毛肌腠和内在脏腑，并将脏腑代谢后产生的浊液下输肾与膀胱，以成尿液生成之源。由于小肠参与了人体的水液代谢，故有“小肠主液”之说（C对）。胆主决断（A错）。胃主受纳和腐熟水谷（B错）。大肠主津（D错）。膀胱之气主通降（E错）。